与水俣病有关的物质是
A. 镉
B. 苯酚
C. 铅
D. 甲基汞
E. 多氯联苯

正确答案：D。甲基汞

解析：本题考查与水俣病有关的物质。水俣病是因食入被有机汞污染河水中的鱼、贝类所引起的甲基汞（D对ABCE错）为主的有机汞中毒或是孕妇吃了被有机汞污染的海产品后引起婴儿患先天性水俣病，是有机汞侵入脑神经细胞而引起的一种综合性疾病。